双氯芬酸钠是
A. 吡唑酮类解热镇痛药
B. N-芳基邻氨基苯甲酸类非甾体抗炎药
C. 苯乙酸类非甾体抗炎药
D. 芳基丙酸类非甾体抗炎药
E. 抗通风药

正确答案：C。苯乙酸类非甾体抗炎药